我国肝硬化最常见的病因是
A. 慢性酒精中毒
B. 乙型病毒性肝炎
C. 自身免疫性肝炎
D. 丙型病毒性肝炎
E. 药物中毒

正确答案：B。乙型病毒性肝炎

解析：本题考查我国肝硬化最常见的病因。我国肝硬化最常见的病因是乙型病毒性肝炎（B对）。慢性酒精中毒（A错）、乙型病毒性肝炎、自身免疫性肝炎（C错）、丙型病毒性肝炎（D错）、药物中毒（E错）均可导致肝硬化，但在我国肝硬化最常见的病因是乙型病毒性肝炎；在欧美国家，酒精及丙型肝炎病毒(HCV)为多见病因。